患者男30岁，诉自发性牙痛2天，口含冰块可暂时缓解，拟诊为
A. 急性根尖周炎
B. 急性牙髓炎化脓期
C. 急性冠周炎
D. 急性牙周脓肿
E. 可复性牙髓炎

正确答案：B。急性牙髓炎化脓期

解析：本题考查急性牙髓炎的临床表现。患者男30岁，诉自发性牙痛2天，口含冰块可暂时缓解，拟诊为急性牙髓炎化脓期（B对）。急性牙髓炎的疼痛性质具有自发性阵发性痛、温度刺激加剧疼痛等特点，若患牙正处于疼痛发作期，温度刺激可使疼痛加剧，如果牙髓已有化脓或部分坏死，即处于急性牙髓炎化脓期时，患牙可表现为所谓的热痛冷缓解，这可能是因为牙髓的病变产物中有气体出现，受热膨胀后使髓腔内压力进一步增高，产生剧痛，反之，冷空气或凉水可使空气气体体积收缩，减小压力而缓解疼痛，临床上常可见到患者携带凉水瓶就诊，随时含漱冷水进行止痛。可复性牙髓炎（E错）无自发痛史，对温度刺激有一过性敏感的反应。急性根尖周炎（A错）以患牙及其周围组织肿痛为主要表现，急性冠周炎（C错）表现为患侧磨牙后区胀痛不适，炎症侵及咀嚼肌时可出现不同程度的张口受限，急性牙周脓肿（D错）可在患牙的唇颊侧或舌腭侧牙龈形成椭圆形或半球状的肿胀突起，疼痛明显，急性根尖周炎、急性冠周炎和急性牙周脓肿均没有热痛冷缓解的疼痛特点。